面神经颅外段分支描述错误的是
A. 颞支受损，同侧额纹消失
B. 颧支损伤后眼睑不能闭合
C. 颊支损伤可出现鼻唇沟变深
D. 下颌缘支损伤，可导致患侧口角下垂及流涎
E. 颈支分布于颈阔肌

正确答案：C。颊支损伤可出现鼻唇沟变深

解析：颅外段的分支：（1）颞支受损，同侧额纹消失（2）颧支损伤后眼睑不能闭合（3）颊支损伤可出现鼻唇沟变浅或消失、鼓腮无力、上唇运动力减弱或偏斜以及食物积存于颊龈沟等症状（4）下颌缘支损伤，可导致患侧口角下垂及流涎
（5）颈支：分布于颈阔肌，并有分支与颈横神经交通掌握“面神经、舌咽神经、舌下神经的分支与分布”知识点。